在下颌骨内斜线的上方，颏棘两侧的凹陷，其结构名称是
A. 二腹肌窝
B. 舌下腺窝
C. 下颌下腺窝
D. 关节翼肌窝
E. 以上都不是

正确答案：B。舌下腺窝

解析：本题考查下颌骨的内面。在下颌骨内斜线的上方，颏棘两侧的凹陷，其结构名称是舌下腺窝（B对）。在下颌体的内面，近中线处有上下两对突起，称为上颏棘和下颏棘，分别为颏舌肌和颏舌骨肌起点，自下颏棘下方斜向后上与外斜线相应的骨嵴名内斜线或下颌舌骨线，为下颌舌骨肌起点，内斜线的后端有翼下颌韧带附着，内斜线将下颌体内面分为上下两部：内斜线上方，颏棘两侧有舌下腺窝，与舌下腺相邻。内斜线下方，中线两侧近下颌骨下缘处，有不明显的卵圆形陷窝称二腹肌窝（A错），是二腹肌前腹的起点。二腹肌窝的后上方又有下颌下腺窝（C错）与下颌下腺相接。关节翼肌窝是髁突颈部前上方的小凹陷，为翼外肌下头的附着处（D错）。